流行病学三角模型中的“三角”是指
A. 生物环境、社会环境和物质坏境
B. 遗传、宿主和环境
C. 致病因素、宿主和环境
D. 传染源、传播途径和易感人群
E. 遗传、环境和病原微生物

正确答案：C。致病因素、宿主和环境

解析：流行病学三角模型中的“三角”是指致病因子、宿主和环境（C对）。